色谱法中，符号n代表
A. 理论板数
B. 理论板高
C. 保留时间
D. 分离度
E. 半高峰宽

正确答案：A。理论板数

解析：本题考查高效液相色谱法系统适用性试验。色谱系统适用性试验通常包括理论板数（n）（A对）、分离度（R）（D错）、重复性、灵敏度和拖尾因子（T）四项指标。理论板高（B错）用H表示。保留时间（C错）用tR表示。半高峰宽（E错）用Wh/2表示。